妊娠37周患者，早晨醒来时发现躺在血泊中，急诊送入院，查：血压12.0/8.0kPa（90/60mmHg），脉搏120次/分，神清，宫高37cm，臀先露，高浮，胎心音160次/分，骨盆正常，阴道少量活动性流血。选哪项处理最恰当
A. 人工破膜
B. 期待疗法
C. 在输血输液同时行剖宫产
D. 臀位牵引术
E. 催产素滴注引产

正确答案：C。在输血输液同时行剖宫产

解析：本例诊断为前置胎盘，因为患者有多量出血，出现了休克的症状，并且妊娠已达37周，需要边纠正休克边终止妊娠，故选C。掌握“前置胎盘”知识点。